健康危险因素评价是从疾病自然史的第几个阶段开始
A. 1
B. 2
C. 3
D. 4
E. 5

正确答案：A。1